若数据分布图形符合正态分布，则以下说法正确的是
A. 左右两侧不对称
B. 以标准差为中心
C. 近均数两侧频数较少
D. 离均数越远，则频数较多
E. 均数所在处最高

正确答案：E。均数所在处最高

解析：正态分布是一种重要的连续型分布，以均数为中心，左右两侧基本对称，靠近均数两侧频数较多，离均数愈远，频数愈少。掌握“定量资料的统计描述和推断”知识点。